水饮流溢于四肢，称为
A. 痰饮
B. 伏饮
C. 悬饮
D. 溢饮
E. 支饮

正确答案：D。溢饮

解析：饮证包括痰饮、悬饮、支饮、溢饮。溢饮为身体疼痛而沉重，甚则肢体浮肿，当汗出而汗不出，或伴咳喘，属饮流肢体（D对）。痰饮为心下满闷，呕吐清水痰涎，胃肠沥沥有声，形体昔肥今瘦，属饮停肠胃（A错）。伏饮指水饮潜伏于内，难于攻除，发作有时之证（B错）。悬饮为胸胁饱满，咳唾引痛，喘促不能平卧，或有肺痨病史，属饮流胁下（C错）。支饮为咳逆倚息，短气不得平卧，其形如肿，属饮邪聚于胸肺（E错）。